男，46岁，保安。过去曾从事采石作业1年，近来呼吸困难、咳嗽、咳痰。查体：体温37℃，心率90次/min，胸部听诊有啰音。X线片表现：两肺出现团块状阴影，胸膜呈“天幕状”阴影。该患者最可能患有
A. 晚发型硅沉着病
B. 肺癌
C. 肺炎
D. 血行播散性肺结核
E. 肺含铁血黄素沉着症

正确答案：A。晚发型硅沉着病